痛痛病是一种
A. 职业病
B. 公害病
C. 地方病
D. 传染病
E. 职业性多发病

正确答案：B。公害病

解析：本题考查痛痛病。痛痛病是一种公害病（B对ACDE错），是发生在日本富山县神通川流域部分镉污染地区的一种严重的环境污染性疾病，以全身剧烈疼痛为主要症状而得名，是慢性镉中毒的典型案例。主要原因是当地居民长期饮用受镉污染的河水，并食用此水灌溉的含镉稻米，致使镉在体内蓄积，发生慢性镉中毒，导致了痛痛病的发生。